血白细胞总数增多，可见于
A. 再生障碍性贫血
B. 急性大出血
C. 使用氯霉素的影响
D. 脾功能亢进
E. 伤寒杆菌感染

正确答案：B。急性大出血

解析：血白细胞总数增多，可见于急性大出血（B对）。这是因为急性大出血，尤其是内出血时，机体处于应激状态，导致边缘池及骨髓内的中性粒细胞大量释放入血，引起白细胞总数明显增多。再生障碍性贫血（A错）表现为骨髓造血能力减弱；使用氯霉素（C错）会引起骨髓抑制；脾功能亢进（D错）会出现脾脏滤血功能亢进，大量血细胞（包括红细胞、白细胞）及血小板被阻留在脾内并被破坏和吞噬；伤寒杆菌感染（E错），大多数白细胞吞噬伤感杆菌而死亡。